四逆散的功用是
A. 透邪解郁、疏肝理脾
B. 透邪解郁、补脾泻肝
C. 透邪解郁、理气和中
D. 疏肝解郁、健脾和胃
E. 疏肝解郁、行气和血

正确答案：A。透邪解郁、疏肝理脾

解析：四逆散方含柴胡疏肝解郁，透邪外出；白芍敛阴养血柔肝；枳实理气解郁，泻热破结；甘草调和诸药，益脾和中，诸药合用，共奏透邪解郁，疏肝理脾之功（A对）。